根据《药品说明书和标签管理规定》规定，有效期表述形式错误的是
A. 有效期至2012年06月
B. 有效期至2012/06
C. 有效期至2012.6.6
D. 有效期至2012.06.06
E. 有效期至2012年06月06日

正确答案：C。有效期至2012.6.6

解析：本题考查药品的有效期表述形式。根据《药品说明书和标签管理规定》规定，有效期表述形式错误的是有效期至2012.6.6（C错，为本题正确答案）。《药品说明书和标签管理规定》第二十三条规定，药品标签中的有效期应当按照年、月、日的顺序标注，年份用四位数字表示，月、日用两位数表示。其具体标注格式为“有效期至XXXX年XX月”（A对）或者“有效期至XXXX年XX月XX日（E对）”；也可以用数字和其他符号表示为“有效期至XXXX.XX.（D对）”或者“有效期至XXXX/XX/XX”（B对）等。